阴疮之热毒证，治疗宜选
A. 五味消毒饮
B. 仙方活命饮
C. 知柏地黄丸
D. 龙胆泻肝汤
E. 加味五苓散

正确答案：D。龙胆泻肝汤

解析：阴疮热毒证的主要证候为阴部生疮,灼热结块,甚则溃烂流脓,黏稠臭秽；恶寒发热,头晕目眩,口苦咽干,心烦不宁,便秘尿黄;舌红,苔黄,脉滑数。治宜清热利湿,解毒消疮。方选龙胆泻肝汤加土茯苓、蒲公英（D对）。